关于药品贮藏条件中的冷处保存，其温度是指
A. -20℃
B. -10℃
C. -2℃
D. 0℃
E. 2～10℃

正确答案：E。2～10℃

解析：本题考查中国药典的凡例。关于药品贮藏条件中的冷处保存，其温度是指2～10℃（E对）。冷处系指贮藏处温度为 2°C ~ 10°C。阴凉处系指贮藏处温度不超过20℃。凉暗处系指贮藏处避光并温度不超过20℃。常温系指温度为10℃～30℃。-20℃（A错）、-10℃（B错）、-2℃（C错）、0℃（D错）均属冷冻贮藏，大多数药物不需冷冻贮藏，只有极少数药物需冷冻，如卡前列甲酯栓需低于-5℃运输及贮藏。